预激综合征合并快速心房颤动时宜选择的治疗药物为
A. 地尔硫䓬（硫氮䓬酮）
B. 洋地黄
C. 阿托品
D. 利多卡因
E. 胺碘酮

正确答案：E。胺碘酮

解析：预激综合征合并快速心房颤动时伴有晕厥或低血压，应立即电复律。治疗药物宜选用延长房室旁路不应期的药物。胺碘酮（P205）（E对）为Ⅲ类抗心律失常药，可阻断钾通道与延长复极，从而延长房室旁路不应期，可用于预激综合征合并快速心房颤动的治疗。其他治疗药物还包括普鲁卡因胺和普罗帕酮（P205）。地尔硫䓬（硫氮䓬酮）（A错）和利多卡因（D错）会加速预激综合征合并心房颤动患者的心室率，禁用于预激综合征合并房颤者。洋地黄（B错）可缩短旁路不应期使心室率加快，也不能用于预激综合征合并房颤者。阿托品（九版药理学P65）（C错）可缩短房室结的有效不应期，增加房颤或房扑患者的心室率。